宜于餐前一小时服用的胃黏膜保护剂是
A. 奥美拉唑
B. 地塞米松
C. 枸橼酸铋钾
D. 多潘立酮
E. 法莫替丁

正确答案：C。枸橼酸铋钾

解析：本题考查药物的使用。枸橼酸铋钾（C对）属于胃黏膜保护剂，宜在餐前1h或睡前服用。奥美拉唑（A错）属于质子泵抑制剂，在晨起或餐前30min内服用比较好。法莫替丁（E错）属于组胺H₂受体阻断剂，在餐后或睡前服用。地塞米松（B错）属于肾上腺糖皮质激素，用药时间因给药方式不同而不同。多潘立酮（D错）属于促动力药，宜在餐前15～20min服用。